自言自语，喃喃不休，见人语止，首尾不续
A. 郑声
B. 独语
C. 言謇
D. 谵语
E. 错语

正确答案：B。独语

解析：独语是指自言自语，喃喃不休，见人语止，首尾不续（B对）；郑声是指神识不清，语言重复，时断时续，语声低弱模糊（A错）；言謇即语謇，是指神志清楚，思维正常，但语言不流利，或吐字不清因习惯而成者，称为口吃，不属病态（C错）；谵语是指神识不清，语无伦次，声高有力（D错）；错语是指神识清楚而语言时有错乱，说后自知言错（E错）。